某人平均每日摄入能量3000千卡，硫胺素1.0mg，核黄素1.6mg，尼克酸15mg，为对此人硫胺素营养状况进行评价，选择的可靠方法为
A. TPP效应
B. GRAC
C. 脯氨酸
D. 磷酸吡哆醛
E. 同型半胱氨酸

正确答案：A。TPP效应